能清热燥湿的药，其性味大多
A. 酸温
B. 苦寒
C. 辛温
D. 甘温
E. 咸寒

正确答案：B。苦寒

解析：本题考查的是气味配合与疗效的关系。能清热燥湿的药，其性味大多苦寒（B对）。气味配合与疗效的关系，概之有二：一为气味相同，功能相近。辛温（C错）的药多能发散风寒，如麻黄、紫苏等；辛凉的药多能发散风热，如薄荷、菊花等；苦寒的药多能清热解毒或清热燥湿，如黄芩、黄连等；甘温的药多能补气或助阳，如黄芪、锁阳等；苦甘（或甘苦）寒的药多能清热滋阴，如知母、玄参、北沙参、石斛等。有时气味也有主次之别，如黄芪与锁阳虽均为甘温，但黄芪以甘为主则补气，锁阳以温为主则助阳。二为气味相异，功能不同。其中有味异气同者，如麻黄辛温能散寒发表、杏仁苦温能降气止咳、乌梅酸温（A错）能敛肺涩肠、大枣甘温（D错）能补脾益气、肉苁蓉咸温能补肾助阳；有味同气异者，如桂枝辛温能发表散寒、薄荷辛凉能发表散热、附子辛热能补火助阳、石膏辛寒能清热泻火等。性味咸寒（E错）中药的功效，2022年考试指南未明确说明。